表面有钉头，主成分为Fe₂O₃的药材是
A. 雄黄
B. 朱砂
C. 石膏
D. 自然铜
E. 赭石

正确答案：E。赭石

解析：本题考查的是赭石的来源与性状鉴别。表面有钉头，主成分为Fe₂O₃的药材是赭石（E对）。是赭石：【来源】为氧化物类矿物刚玉族赤铁矿。主含三氧化二铁（Fe₂O₃）。【性状鉴别】药材为鲕状、豆状、肾状集合体。多呈不规则的扁平块状。暗棕红色或灰黑色，条痕樱红色或红棕色，有的有金属光泽。一面多有圆形的突起，习称“钉头”；另一面与突起相对应处有同样大小的凹窝。体重，质硬，砸碎后断面显层叠状。气微，味淡。雄黄（A错）：【来源】为硫化物类矿物雄黄族雄黄。主含二硫化二砷（As₂S₂）。【性状鉴别】药材为块状或粒状集合体，呈不规则块状。深红色或橙红色，条痕淡橘红色，晶面有金刚石样光泽。质脆，易碎，断面具树脂样光泽。微有特异臭气，味淡。精矿粉为粉末状或粉末集合体，质松脆，手捏即成粉，橙黄色，无光泽。朱砂（B错）：【来源】为硫化物类矿物辰砂族辰砂。主含硫化汞（HgS）。【性状鉴别】药材为粒状或块状集合体，呈颗粒状或块片状。鲜红色或暗红色，条痕红色至褐红色，具光泽。体重，质脆，片状者易破碎，粉末状者有闪烁的光泽。气微，味淡。石膏（C错）：【来源】为硫酸盐类矿物硬石膏族石膏。主含含水硫酸钙（CaSO₄·2H₂O）。【性状鉴别】药材为纤维状的集合体。呈长块状、板块状或不规则块状。白色、灰白色或淡黄色，有的半透明。体重，质软，纵断面具绢丝样光泽。气微，味淡。自然铜（D错）：【来源】为硫化物类矿物黄铁矿族黄铁矿。主含二硫化铁（FeS₂）。【性状鉴别】药材晶型多为立方体，集合体呈致密块状。表面亮淡黄色，有金属光泽；有的黄棕色或棕褐色，无金属光泽。具条纹，条痕绿黑色或棕红色。体重，质坚硬或稍脆，易砸碎，断面黄白色，有金属光泽；或断面棕褐色，可见银白色亮星。